对急性传染病接触者采取措施时间是
A. 开始接触之日算起，相当于该病的最长潜伏期
B. 最后接触之日算起，相当于该病的最短潜伏期
C. 开始接触之日算起，相当于该病的平均潜伏期
D. 最后接触之日算起，相当于该病的平均潜伏期
E. 最后接触之日算起，相当于该病的最长潜伏期

正确答案：E。最后接触之日算起，相当于该病的最长潜伏期

解析：本题考查急性传染病接触者采取措施时间计算方法。针对急性传染病接触者采取措施的时间应以最后接触之日算起，相当于该病的最长潜伏期（E对ABCD错）。